翼腭间隙向下通口腔的途径结构是
A. 眶下裂
B. 蝶腭孔
C. 翼腭管
D. 圆孔
E. 翼上颌裂

正确答案：C。翼腭管

解析：本题考查翼腭窝。翼腭间隙向下通口腔的途径结构是翼腭管（C对）。翼腭间隙向下经翼腭管通口腔，向前经眶下裂（A错）通眼眶，向内经蝶腭孔（B错）通鼻腔，向后上经圆孔（D错）通颅腔，向外经翼上颌裂（E错）通颞下间隙。